饮水臭氧消毒的缺点是
A. 投资大，投加量不易调节
B. 接触时间长
C. 对细菌、病毒的杀灭效果低
D. 产生卤仿反应
E. 以上都不是

正确答案：A。投资大，投加量不易调节

解析：本题考查饮水臭氧消毒的缺点。饮水臭氧消毒的缺点是投资大，投加量不易调节（A对BCDE错）。水中O₃不稳定，易自行分解，且控制和检测O₃需一定的技术，在水中保留时间很短，不能维持管网持续的消毒效率，需要第二消毒剂。